中药饮片正名是规范化的饮片名称，除正名以外的名称为别名。关于饮片别名的说法，错误的是
A. 丹参的别名是紫参
B. 茜草的别名活血丹
C. 百部的别名野天门冬
D. 艾叶的别名冰台
E. 千金子的别名续随子

正确答案：A。丹参的别名是紫参

解析：本题考查常见的饮片正名与相关别名。关于饮片别名的说法，错误的是丹参的别名是紫参（A错，为本题正确答案）。丹参的别名是紫丹参、赤参。茜草的别名活血丹（B对）、红茜草、茜草根、茜根、血见愁、地血。百部的别名野天门冬（C对）、百部草、肥百部。艾叶的别名冰台（D对）、祁艾、蕲艾、灸草。千金子的别名续随子（E对）。